抽样调查中，抽样误差从小到大的顺序是
A. 整群抽样、分层抽样、系统抽样、单纯随机抽样
B. 整群抽样、单纯随机抽样、分层抽样、系统抽样
C. 分层抽样、系统抽样、单纯随机抽样、整群抽样
D. 分层抽样、系统抽样、整群抽样、单纯随机抽样
E. 系统抽样、单纯随机抽样、整群抽样、分层抽样

正确答案：C。分层抽样、系统抽样、单纯随机抽样、整群抽样

解析：本题考查抽样方法的抽样误差。常见抽样方法抽样误差从小到大排列为：分层抽样≤系统抽样≤单纯随机抽样≤整群抽样（C对ABDE错）。